防止振动危害的最根本性措施是
A. 制定合理的卫生标准
B. 进行工艺改革避免接触振动体
C. 建立合理劳动休息制度
D. 采取隔振减振措施
E. 使用有效的个人防护用品

正确答案：B。进行工艺改革避免接触振动体

解析：本题考查防止振动危害的措施。振动危害的主要措施为四项，包括：①控制振动源，通过改革工艺过程，采取技术革新，通过减振、隔振等措施，减轻或消除振动源的振动（B对ACDE错），是预防振动职业危害的根本措施；②限制作业时间和振动强度；③改善作业环境，加强个人防护；④加强健康监护和日常卫生保健。